女性，48岁。突发右上腹剧烈绞痛，伴右肩背痛、恶心呕吐24小时。既往有类似发作。吃油脂食物后右上腹胀，嗳气。T39.8℃,P98次/分，BP140/90mmHg，无黄疸，可触及肿大胆囊，有明显腹膜刺激征，Murphy征阳性。首先考虑的诊断是
A. 十二指肠溃疡
B. 肝外胆管结石
C. 急性化脓性胆囊炎
D. 急性梗阻性化脓性胆管炎
E. 急性胰腺炎

正确答案：C。急性化脓性胆囊炎

解析：中年女性患者，既往吃油脂食物后右上腹胀，嗳气，突发右上腹剧烈绞痛（胆囊炎的典型症状），伴右肩背痛、恶心呕吐24小时，T39.8℃（正常值为36℃～37℃，提示发热），P98次/分（正常值为60～100次/分），BP140/90mmHg（正常值为90～140/60～90mm/Hg），无黄疸，可触及肿大胆囊，有明显腹膜刺激征（提示弥漫性腹膜炎），Murphy征阳性（提示胆囊炎），根据患者的病史、临床症状及体征考虑，最可能的诊断为急性化脓性胆囊炎（C对），十二指肠溃疡（A错）主要表现为空腹痛或夜间痛，进餐后可缓解。肝外胆管结石（B错）一般无症状或仅有上腹部不适，当结石造成胆管梗阻时可出现反复腹痛或黄疸。急性梗阻性化脓性胆管炎（D错）主要表现为腹痛、寒战高热、黄疸、神经症状及休克，该患者无黄疸、神经症状及休克。急性胰腺炎（E错）常于饱餐和饮酒后突然发作，腹痛剧烈，多位于左上腹，向左肩及左腰背部放射。